检测病毒病进行微生物学检查时，不是标本采集原则的是
A. 无菌操作
B. 发病早期采集
C. 采集病变部位标本
D. 查抗体时，采早期血清即可
E. 尽快送检，暂保存时放﹣70℃

正确答案：D。查抗体时，采早期血清即可